急性肾盂肾炎的疗程通常是
A. 1周
B. 2周
C. 3周
D. 4周
E. 6周

正确答案：B。2周

解析：急性肾盂肾炎的治疗疗程通常为2周（B对）。对于病情比较轻的患者，可以在门诊口服药物治疗，疗程为10～14天，治疗14天以后，通常90%可以治愈。当病人全身中毒症状明显时，应该住院治疗，静脉给药，治疗疗程也不能少于两周。